少尿指尿量为
A. 100ml以下/24h
B. 100～500mL/24h
C. 1000～2000m/24h
D. 2000～2500ml/24h
E. 2500ml以上/24h

正确答案：B。100～500mL/24h